下列哪项不属于小脑的功能
A. 调节内脏活动
B. 维持身体平衡
C. 维持姿势
D. 协调随意运动
E. 调节肌紧张

正确答案：A。调节内脏活动